房室结
A. 位于上腔静脉与右心房交界处心内膜深面
B. 位于koch三角的尖端
C. 是心室收缩的起搏点
D. 通常由左冠状动脉旋支供血
E. 无

正确答案：B。位于koch三角的尖端

解析：位于Koch三角的尖端（B对）为房室结，其尖对着膜性室间隔的房室部。